体检发现单侧肺底部湿性啰音，且长期固定存在的情况最常见于
A. 支气管扩张
B. 慢性阻塞性肺疾病
C. 心力衰竭
D. 肺结核
E. 特发性肺纤维化

正确答案：A。支气管扩张

解析：体检发现单侧肺底部湿性啰音，且长期固定存在的情况最常见于支气管扩张（A对），此为支气管扩张的典型体征，原因为支气管扩张时，气道内有较多分泌物，且其病变部位不会发生改变。慢性阻塞性肺疾病（B错）病变范围广，涉及全肺的小气道，不会局限于单侧肺底部。心力衰竭（C错）会造成肺淤血、肺水肿，听诊可闻及湿啰音，但是双侧肺底部均可闻及。继发性肺结核（D错）的好发部位是肺上叶下部及肺下叶背段，原发性肺结核的好发部位于肺门部，无继发感染时均为干性啰音。特发性肺纤维化（E错）听诊特点为在双肺基底部闻及吸气末细小的Velcro啰音。